粒细胞缺乏症是指
A. 低于3×10⁹/L
B. 低于2×10⁹/L
C. 低于1.5×10⁹/L
D. 低于1×10⁹/L
E. 低于0.5×10⁹/L

正确答案：E。低于0.5×10⁹/L

解析：粒细胞缺乏症的诊断标准是指外周血的中性粒细胞绝对值低于0.5×10⁹/L（E对）。外周血的中性粒细胞绝对值低于1.5×10⁹/L是10岁以下儿童中性粒细胞减少症的标准（C错）。